男孩，3岁，自幼人工喂养，食欲极差，有时腹泻。身高85cm，体重7500g。皮肤干燥苍白，腹部皮下脂肪厚度约0.3cm。脉搏缓慢，心音较低钝。假设此患儿清晨突然面色苍白、神志不清、体温不升、呼吸暂停，首先应考虑最可能的原因是
A. 急性心力衰竭
B. 低钙血症引起喉痉挛
C. 低钾血症引起呼吸肌麻痹
D. 自发性低血糖
E. 脱水引起休克

正确答案：D。自发性低血糖

解析：自发性低血糖（D对）（第七版诸福棠实用儿科学P511）是营养不良患儿的并发症之一，主要表现为体温不升，面色灰白，神志不清，脉搏缓慢乃至呼吸暂停，但没有抽搐。幼儿急性心力衰竭（A错）（P290）症状与成人相似，主要为乏力、活动后气急，安静时心率增快，呼吸浅快。低钙血症引起喉痉挛（B错）常伴随着全身惊厥、抽搐以及口唇颜面部青紫，而不是面色苍白。低钾血症引起呼吸肌麻痹（C错）通常伴随着功能性的肠梗阻，肠鸣音消失，没有腹泻。脱水引起休克（E错）血压虽然减低甚至消失，但是脉搏和心率却增快且细弱。